一侧眼全盲，损伤的部位在
A. 视神经
B. 视束
C. 内侧膝状体
D. 视交叉不交叉纤维
E. 视辐射

正确答案：A。视神经

解析：当视觉传导通路的不同部位受损时，可引起不同的视野缺损： 视网膜损伤引起的视野缺损与损伤的位置和范围有关； 一侧视神经（A对）损伤可致该侧眼视野全盲； 视交叉中交叉纤维损伤可致双眼视野颞侧半偏盲；一侧视束及以后的视觉传导路（视辐射、视区皮质）受损，可致双眼病灶对侧半视野同向性偏盲（如右侧受损则右眼视野鼻侧半和左眼视野颞侧半偏盲）。